化学致癌过程有多个因素参与，下述哪一项除外
A. 细胞增殖
B. 细胞程序性死亡
C. DNA修复
D. 代谢酶激活

正确答案：D。代谢酶激活

解析：本题考查化学致癌过程的因素。致癌化学分子通过皮肤粘膜或呼吸道进入人体细胞中，一般致癌分子都具有极高亲和性，进入细胞后，与细胞内的DNA或极其重要的RNA或蛋白质进行结合，使其化学结构发生改变失去作用或者改变其作用，从而达到致癌的作用。化学致癌过程的参与因素有细胞增殖（A对）、细胞程序性死亡（B对）和DNA修复（C对）。代谢酶激活（D错，为本题正确答案）不参与化学致癌过程。